由大承气汤化裁为小承气汤属于
A. 药味加减的变化
B. 药量增减的变化
C. 剂型更换的变化
D. 药味加减与药量增减变化的联合运用
E. 药味加减与剂型更换变化的联合运用

正确答案：D。药味加减与药量增减变化的联合运用

解析：大承气汤的药物组成为芒硝三合、大黄四两、枳实五枚、厚朴半斤，治以峻下热结；小承气汤的药物组成为大黄四两、枳实三枚、厚朴二两，治以轻下热结，故二者之间属于药味加减与药量增减变化的联合运用（D对）。